接种乙肝疫苗后，血清免疫学检查可呈阳性反应的指标是
A. 乙型肝炎病毒表面抗原
B. 乙型肝炎病毒表面抗体
C. 乙型肝炎病毒e抗原
D. 乙型肝炎病毒e抗体
E. 乙型肝炎病毒核心抗体

正确答案：B。乙型肝炎病毒表面抗体

解析：本题考查乙型肝炎血清免疫学检查。接种乙肝疫苗后，血清免疫学检查可呈阳性反应的指标是乙型肝炎病毒表面抗体（B对）。乙型肝炎病毒表面抗体阳性：（1）乙型肝炎恢复期，或既往曾感染过HBV, 现已恢复，且对HBV具有一定的免疫力。（2）接种乙肝疫苗所产生的效果。乙型肝炎病毒表面抗原（A错）阳性：（1）提示急性或慢性乙型肝炎，与HBV染有关的肝硬化或原发性肝癌。（2）肝功能已恢复正常而HBsAg尚未转阴，或HBsAg阳性持续6个月以上，而患者既无乙肝症状也无ALT异常，即所谓HBsAg携带者。乙型肝炎病毒e抗原（C错）阳性：（1）乙型肝炎活动期，在HBV感染的早期，HBeAg阳性表示血液中含有较多的病毒颗粒，提示肝细胞有进行性损害和血清具有高度传染性；若血清中HBeAg持续阳性，则提示乙型肝炎转为慢性，表明患者预后不良。（2）HBsAg和HBeAg均为阳性的妊娠期女性，可将HBV传播给新生儿，其感染的阳性率70%～90%。乙型肝炎病毒e抗体（D错）阳性：（1）HBeAg转阴的患者，即HBV部分被清除或抑制，病毒复制减少，传染性降低。（2）部分慢性乙型肝炎、肝硬化、肝癌患者可检出抗-HBe。乙型肝炎病毒核心抗体（E错）阳性：（1）HBc-IgM阳性，是诊断急性乙型肝炎和判断病毒复制活跃的指标。（2） HBc-IgG阳性，在急性HBV感染后可能一直存在。